肝硬化最常见的并发症是
A. 门静脉血栓形成
B. 原发性肝癌
C. 肝性脑病
D. 上消化道大出血
E. 自发性腹膜炎

正确答案：D。上消化道大出血

解析：肝硬化最常见的并发症是上消化道出血（D对）。主要由于以下原因：①门静脉侧支循环开放，食管胃底静脉曲张，易致曲张静脉破裂出血；②门静脉高压使胃黏膜静脉回流缓慢，胃十二指肠的上皮后保护机制削弱，消化性溃疡及急性出血性糜烂性胃炎形成；③胃黏膜下的动-静脉交通支开放，胃黏膜毛细血管扩张，广泛渗血，形成门脉高压性胃病。门静脉血栓形成（A错）、原发性肝癌（B错）、肝性脑病（C错）、自发性腹膜炎（E错）也都是肝硬化的并发症，但是都不如上消化道出血常见。其中肝性脑病是肝硬化患者最严重的并发症，也是最常见的死亡原因。